开口运动的力主要来源于
A. 翼外肌下头
B. 翼内肌下头
C. 翼内肌上头
D. 翼外肌上头
E. 以上答案均错误

正确答案：A。翼外肌下头

解析：开口运动的力：在开口运动过程中，下颌颏部向下后方运动，运动力主要来自舌骨上肌群。髁突向前下运动，运动力主要来自翼外肌下头。掌握“下颌运动的形式、范围及意义”知识点。